不属于非镇静类H₁受体拮抗剂药物有
A. 盐酸西替利嗪
B. 盐酸苯海拉明
C. 马来酸氯苯那敏
D. 盐酸赛庚啶
E. 氯雷他定

正确答案：B、C、D。盐酸苯海拉明；马来酸氯苯那敏；盐酸赛庚啶